患儿，见口腔舌面满布白屑，面赤唇红，烦躁不宁，啼哭叫扰，大便干结，小便短黄，舌质红，苔白腻，脉滑数。辨证为
A. 鹅口疮，虚火上浮型
B. 鹅口疮，心脾积热型
C. 口疮，心火上炎型
D. 口疮，虚火上浮型
E. 口疮，风热乘脾型

正确答案：B。鹅口疮，心脾积热型

解析：该题主要考查对鹅口疮的辩证。鹅口疮是以口腔、舌上蔓生白屑为主要临床特征的一种口腔疾病。因其状如鹅口，故称鹅口疮。该患儿，见口腔舌面满布白屑，面赤唇红，烦躁不宁，啼哭叫扰，大便干结，小便短黄，舌质红，苔白腻，脉滑数。可判断为鹅口疮 心脾积热型（B对）。鹅口疮虚火上浮型，证候口腔内白屑散在，周围红晕不著，形体瘦弱，颧红，手足心热，口干不渴，舌红，苔少，脉细或指纹紫（A错）。口疮心火上炎型，证候红，苔薄黄舌上、舌边溃疡，色赤疼痛，饮食困难，心烦不安，口干欲饮，小便短黄，舌尖脉数,指纹紫（C错）。口疮虚火上浮型，证候口腔溃疡或糜烂，周围色不红或微红，疼痛不甚，反复发作或迁延不愈，神疲颧红，口干不渴，舌红，苔少或花剥，脉细数，指纹淡紫（D错）。口疮风热乘脾型，证候以口颊、上颗、齿跟、口角溃烂为主，甚则满口糜烂，周围锨红，疼痛拒食，烦躁不安，口臭，涎多，小便短赤，大便秘结，或伴发热，舌红，苔薄黄，脉浮数，指纹紫（E错）。